“伤寒二三日，心中悸而烦着”，治宜选用
A. 炙甘草汤
B. 小建中汤
C. 栀子豉汤
D. 桂枝甘草汤
E. 黄连阿胶汤

正确答案：B。小建中汤

解析：伤寒二三日，未经误治，应该有发热恶寒等表证，却见心悸而烦，宜当明辨。该证一未见热郁胸膈，二未见少阳邪扰，三未见阳明燥实内结，四未见水气凌心，必是里气先虚，气血不足，复被邪扰所致。而气血之生在于脾胃，脾胃不足，气血生化无源，气虚心无所主则悸，血虚神无所敛则烦。此证治法不可攻邪，当建立中气，调补气血，故以小建中汤主之。俾正气恢复，则邪去而正安。此安内攘外之法，有表里兼顾之义（B对）。